某HIV感染者，近日出现继发感染、衰竭、免疫缺陷等AIDS症状，入院治疗。目前认为最有效的治疗方案是
A. 蛋白酶抑制剂
B. 核苷类反转录酶抑制剂
C. 鸡尾酒疗法（联合用药疗法）
D. 非核苷类反转录酶抑制剂
E. 脱氧鸟苷单一用药疗法

正确答案：C。鸡尾酒疗法（联合用药疗法）